丙米嗪是
A. 治疗神经官能症的药物
B. 治疗精神分裂症的药物
C. 治疗躁狂症的药物
D. 治疗抑郁症的药物
E. 治疗焦虑症的药物

正确答案：D。治疗抑郁症的药物

解析：丙米嗪治疗各种抑郁症，对内源性抑郁症、更年期抑郁症及伴有躁狂状态的抑郁症效果较好。抑郁症患者连续服药后，则可明显地改善患者抑郁症状，出现情绪提高、精神振奋的现象（D对）。